关于蛛网膜下隙（腔）的下列说法，不正确的是
A. 位于蛛网膜与软膜之间的间隙
B. 脑与脊髓蛛网膜下隙互相连通
C. 隙内充满着脑脊液
D. 蛛网膜与硬膜之间潜在性的间隙
E. 该隙在某些部位扩大，称池，如小脑延髓池、脚间池、四叠体上池、桥池等

正确答案：D。蛛网膜与硬膜之间潜在性的间隙

解析：蛛网膜下隙是蛛网膜与软膜之间的间隙，而蛛网膜与硬膜之间潜在性的间隙（D错，为本题正确答案）叫做硬膜下隙。